关于子宫动脉描述，错误的是
A. 发自髂内动脉
B. 行经子宫阔韧带二层之间
C. 距子宫颈外侧2cm处有输尿管跨过其前方
D. 供应子宫、卵巢及输卵管
E. 与卵巢动脉吻合

正确答案：C。距子宫颈外侧2cm处有输尿管跨过其前方

解析：子宫动脉发自髂内动脉（A对）。行经子宫阔韧带二层之间（B对）。在子宫颈的外侧约2cm处从输尿管的前方（C错，为本题正确答案）跨过。子宫动脉分支营养子宫、卵巢、输卵管（D对）和阴道，并与卵巢动脉吻合（E对）。